使心跳减慢的植物性神经低级中枢在
A. 中脑
B. 延髓
C. 脊髓胸节前角
D. 脊髓胸节侧角
E. 脑桥

正确答案：B。延髓

解析：使心跳减慢的植物性神经为副交感神经，其中枢位于脑干的一般内脏运动核和脊髓骶部第2-4节段灰质的骶副交感核，即延髓（B对）。